肝病日久，两胁胀满疼痛，并见舌质瘀斑瘀点。其病机是
A. 气滞血瘀
B. 气不摄血
C. 气随血脱
D. 气血两虚
E. 气血失和

正确答案：A。气滞血瘀

解析：肝病日久，肝的机能减弱，疏泄失职，容易导致气血凝滞，出现舌质瘀斑瘀点；肝气瘀滞则会出现两胁胀满疼痛（A对）。气不摄血（B对），可见吐血，咯血，皮肤紫斑，便血，尿血，崩漏。气随血脱（C对），在大量出血的同时，气也随着血液的流失而急剧散脱，从而形成气血并脱的危重病理变化。可出现晕厥、冷汗淋漓，四肢不闻等病理状态。气血两虚（D错），即气虚和血虚同时存在。可见面色淡白，或萎黄、少气懒言、疲乏无力、心悸失眠、肢体麻木。气血失和（E错），主要包括气滞血瘀，气虚血瘀，气不摄血，气随血脱，以及气血两虚等几方面。